引起牙髓病的感染途径有
A. 深龋和牙周病的逆行感染
B. 牙周病逆行感染、深龋和化学药物刺激
C. 电流刺激、咬合创伤、全身慢性消耗性系统疾病
D. 血源性感染、牙周病的逆行感染、深龋或牙体损伤暴露牙髓
E. 外伤、发育畸形和意外穿髓

正确答案：D。血源性感染、牙周病的逆行感染、深龋或牙体损伤暴露牙髓

解析：本题考查牙髓感染的途径。引起牙髓感染的途径主要包括血源性感染、牙周病的逆行感染、深龋或牙体损伤暴露牙髓（D对A错）。化学药物刺激属于化学因素引起的牙髓病变（B错）。电流刺激、咬合创伤属于导致牙髓病的物理因素；全身慢性消耗性系统疾病，导致机体抵抗力低下，有可能发生菌血症而发生血源性感染（C错）。发育畸形属于宿主易感因素，外伤属于物理因素（E错）。